素体津血亏耗者，易致邪从
A. 寒化
B. 虚化
C. 燥化
D. 湿化
E. 实化

正确答案：C。燥化

解析：质化（从化）的一般规律是：素体阴虚阳亢者，功能活动相对亢奋，受邪后多从热化；素体阳虚阴盛者，功能活动相对不足，受邪后多从寒化（A错）；素体津亏血耗者，易致邪从燥化（C对）；气虚湿盛者，受邪后多从湿化（D错）。